山楂的功效
A. 回乳
B. 杀虫
C. 健脾
D. 利水
E. 散瘀

正确答案：E。散瘀

解析：山楂是消食药，酸、甘，微温；入脾、胃、肝经。可消食健胃，行气散瘀血（E对），化浊降脂。能治各种饮食积滞，尤为消化油腻肉食积滞之要药；能行气散结止痛，炒用兼能止泻止痢；能通行气血，有活血祛瘀之功。